属于二次污染物的是
A. 二氧化硫、铅
B. 氮氧化物、碳氢化合物
C. 光化学烟雾
D. 氟化物、氰化物
E. 一氧化碳、二氧化碳

正确答案：C。光化学烟雾

解析：本题考查二次污染物。二次污染物是指排入大气的污染物在物理、化学等因素的作用下发生变化，或与环境中的其他物质发生反应所形成的理化性质不同于一次污染物的新的污染物，如光化学烟雾（C对ABDE错）。